郁金不但具有活血止痛、行气解郁之功，还能
A. 利水通淋，清心除烦
B. 通经络，止痹痛
C. 强筋健骨
D. 凉血清心，利胆退黄
E. 消肿排脓

正确答案：D。凉血清心，利胆退黄

解析：郁金药性辛、苦，寒；归肝、胆、心、肺经；功效是活血止痛，行气解郁，凉血清心，利胆退黄（D对）。灯心草的功效是利水通淋，清心除烦（A错）。海风藤的功效是祛风湿，通经络，止痹痛（B错）。续断的功效是补益肝肾，强筋健骨（C错），止血安胎，疗伤续折。天花粉的功效是清热泻火，生津止渴，消肿排脓（E错）。